患儿，2岁。面色苍白，唇淡甲白，发黄稀疏，神疲乏力，形体消瘦3个月，诊断为“营养性缺铁性贫血”。西药选用铁剂治疗后，正确的停药时间为：血红蛋白
A. 开始升高时
B. 达正常时
C. 达正常后2个月左右
D. 达正常后4个月左右
E. 达正常后6个月左右

正确答案：C。达正常后2个月左右

解析：小儿的营养性缺铁性贫血可使用铁剂治疗，一般用硫酸亚铁，服用至血红蛋白达正常水平后2个月左右再停药（C对）（ABDE错）。